淋巴细胞减少见于
A. 再生障碍性贫血
B. 血管神经性水肿
C. 某些病毒感染，如流行性腮腺炎
D. 结核病
E. 长期接触放射线

正确答案：E。长期接触放射线

解析：淋巴细胞减少：主要见于使用肾上腺糖皮质激素、烷化剂，接触放射线，免疫缺陷性疾病等（E对）。再生障碍性贫血，由于中性粒细胞减少，使淋巴细胞的百分比增高，但其绝对值并不增高（A错）。血管神经性水肿多见嗜酸粒细胞增多（B错）。某些病毒感染，如流行性腮腺炎多见于淋巴细胞增多（C错）。结核病多见于淋巴细胞增多（D错）。